引起肉毒杆菌食物中毒的主要食品是
A. 家庭自制的发酵食品
B. 海产品及盐制食品
C. 肉类及肉类制品
D. 奶类及奶制品
E. 淀粉类食物

正确答案：A。家庭自制的发酵食品